关于解热、镇痛、抗炎的机制，说法错误的是
A. PG具有扩张血管作用，可促使局部组织充血、肿胀
B. COX是PG合成的必需酶，也是PG初始合成步骤中的关键限速酶
C. 花生四烯酸在COX-2的催化作用下，抑制PG的生成
D. COX-1参与血管舒缩、血小板聚集、胃盘膜血流、胃黏液分泌及肾功能等的调节
E. COX包括COX-1和COX-2两种同工酶

正确答案：C。花生四烯酸在COX-2的催化作用下，抑制PG的生成

解析：本题考查解热镇痛抗炎药的作用机制。解热镇痛抗炎药主要通过抑制炎症细胞的花生四烯酸代谢物过程中的环氧化酶（COX）减少炎症介质，从而抑制前列腺素和血栓素的合成（C错，为本题正确答案）。